戊型肝炎是
A. 血液传播
B. 飞沫传播
C. 唾液传播
D. 粪口传播
E. 蚊虫传播

正确答案：D。粪口传播

解析：戊型肝炎属于病毒感染性疾病，主要通过粪口途径传播（D对），水源或食物被污染可引起暴发流行；戊型肝炎也可经日常生活接触传播，是散发性发病的主要传播途径。血液传播（A错）常见于乙型肝炎、艾滋病、梅毒等传染性疾病，不属于戊型肝炎的传播途径。飞沫传播（B错）是空气传播的一种方式，常见于流行性脑脊髓膜炎、猩红热、百日咳、流感、麻疹等传染性疾病，不属于戊型肝炎的传播途径。唾液传播（C错）常见于上呼吸道感染、结核病等传染性疾病，不属于戊型肝炎的传播途径。粪口传播（D错）常见于甲型肝炎、肠道疾病、手足口病等传染性疾病，不属于戊型肝炎的传播途径。蚊虫传播（E错）常见于疟疾、登革热等传染性疾病，不属于戊型肝炎的传播途径。